对革兰阳性菌、革兰阴性菌、厌氧菌等的作用均很强的药物是
A. 第一代头孢菌素
B. 第二代头孢菌素
C. 第三代头孢菌素
D. 第四代头孢菌素
E. 碳青霉烯类抗生素

正确答案：E。碳青霉烯类抗生素

解析：本题考查碳青霉烯类抗生素。碳青霉烯抗生素（E对）为迄今抗菌谱最广、抗菌活性甚强的一类抗生素，其对多种β-内酰胺酶高度稳定，对头孢菌素耐药菌仍可发挥优良抗菌作用。第一代头孢菌素（A错）对革兰阳性菌包括耐青霉素金黄色葡萄球菌的抗菌作用较第二代略强，显著超过第三代，对革兰阴性杆菌较第二、三代较弱。第二代头孢菌素（B错）对革兰阳性菌的抗菌活性较第一代略差或相仿，对革兰阴性菌的抗菌活性较第一代强，较第三代弱。第三代头孢菌素（C错）对革兰阳性菌抗菌活性较第一、二代弱，对革兰阴性菌包括绿脓杆菌、铜绿假单胞菌及厌氧菌如脆弱拟杆菌均有较强的抗菌作用。第四代头孢菌素（D错）对革兰阳性菌、革兰阴性菌、厌氧菌显示广谱抗菌活性，与第三代相比，增强了抗革兰阳性菌活性。